“肺为娇脏”的主要依据是
A. 肺主一身之气
B. 肺外合皮毛
C. 肺朝百脉
D. 肺为水之上源
E. 肺气通于天，不耐寒热

正确答案：E。肺气通于天，不耐寒热

解析：肺叶娇嫩，不耐寒热燥湿诸邪之侵；又上通于鼻窍，外合皮毛，与自然界相通，易受外邪，故说“肺为娇脏”（E对）。外合皮毛只是肺娇弱的部分原因（B错）。